治疗滞产，应首选
A. 合谷
B. 太冲
C. 足三里
D. 血海
E. 至阴

正确答案：A。合谷

解析：该题考查合谷穴的主治病证。合谷穴主治头痛、目赤肿痛、齿痛、鼻衄、口眼歪斜、耳聋等头面五官诸疾；发热恶寒等外感病症，热病无汗或多汗；经闭、滞产等妇产科病症（A对）。至阴穴胎位不正，滞产；头痛，目痛；鼻塞，鼻衄，但取穴不如合谷方便，故不为首选（E错）。太冲穴主治中风、癫狂痫、小儿惊风；头痛眩晕、耳鸣、目赤肿痛、口歪、咽痛等肝经风热病证；月经不调、痛经、闭经、崩漏、带下等妇科经带病证；黄疸、胁痛、腹胀、呕逆等肝胃病证；癃闭、遗尿；下肢痿痹，足跗肿痛（B错）。足三里主治胃痛、呕吐、噎嗝、腹胀、腹泻、痢疾、便秘等胃肠病证；下肢痿痹；癫狂等神志病；乳痈、肠痈等外科疾患；虚劳诸证，为强壮保健要穴（C错）。血海主治月经不调、痛经、经闭等月经病，瘾疹、湿疹、丹毒等血热性皮肤病（D错）。